与宫颈癌有密切关系的病毒是
A. 狂犬病病毒
B. 人乳头瘤病毒
C. 人类细小病毒
D. 人类免疫缺陷病毒
E. 疱疹病毒

正确答案：B。人乳头瘤病毒

解析：人是HPV唯一的自然宿主，是人类肿瘤病毒。其感染可引起乳头状瘤，包括皮肤疣、外生殖器尖锐湿疣等，其中HPV-16、18、31、33等型别，与宫颈癌的发生密切相关。掌握“狂犬病、人乳头瘤病毒”知识点。